患者，男，18岁。左下肢被沸水烫伤，局部疼痛剧烈，遍布水疱，有部分破裂，可见基底部呈均匀红色。据此，确定其烧烫伤的深度是
A. 轻度
B. I度
C. 浅Ⅱ度
D. 深Ⅱ度
E. Ⅲ度

正确答案：C。浅Ⅱ度

解析：烧伤，浅Ⅱ度的创面表现：剧痛，感觉过敏，有水疱，基底部呈均匀红色、潮湿，局部肿胀，本病例烧伤特点与之相符。（C对）。轻度不属于烧伤的深度判断（A错）。I度为红斑，其创面表现：红肿热痛，感觉过敏，表面干燥，本病例烧伤特点与之不符（B错）。深Ⅱ度的创面表现：痛觉消失，有水疱，基底苍白，间有红色斑点、潮湿，本病例烧伤特点与之不符（D错）。Ⅲ度为结痂，其创面表现：痛觉消失，无弹力，坚硬如皮革样，蜡白焦黄或炭化，干燥，干后皮下静脉阻塞如树枝状（E错）。